下列有关消毒的叙述，正确的是
A. 消毒是针对有确定传染源存在的场所进行的
B. 对传染病学死亡患者的尸体按规定进行处理也属消毒
C. 对传染病学住院患者污染过的物品可待其出院后集中消毒
D. 对有病原体携带者没有发病存在的场所可以不消毒
E. 饭前便后的洗手不属消毒的范畴

正确答案：B。对传染病学死亡患者的尸体按规定进行处理也属消毒

解析：终末消毒指传染源离开疫源地，如转出、痊愈或死亡后，对其原居地进行的一次彻底消毒。消毒范围包括患者所处的环境、排泄物和接触过的物品等，以及患者离开前的沐浴更衣等的身体消毒或对死亡患者的尸体处理等（B对）。